关于引起牙髓变性原因描述哪项是正确的
A. 牙髓组织受长期慢性刺激
B. 根尖孔缩窄，牙髓供血不足
C. 牙髓发生增生性改变
D. 发生牙髓变性需要较长时间
E. 以上均是

正确答案：E。以上均是

解析：本题考查牙髓变性。引起牙髓变性原因包括牙髓组织受到长期（D对）慢性刺激（A对）、根尖孔缩窄，牙髓供血不足（B对），这会使牙髓组织代谢障碍而出现的不同程度和不同类型的退行性变。除此之外，牙髓发生增生性改变（C对）也是引起牙髓变性的原因之一（ABCD均对，E为本题的正确答案）。